与临床有关的研究、生产、流通、使用和管理领域的信息，必须
A. 紧密结合临床
B. 内容广泛多样
C. 更新传递快速
D. 强调经济效益
E. 展望未来发展

正确答案：B。内容广泛多样